已知某病患者8人的潜伏期（天）分别是6，8，8，10，12，15，16，17，平均潜伏天数
A. 8
B. 10
C. 11
D. 12
E. 15

正确答案：C。11

解析：平均潜伏天数为11（C对）天。常用的平均数计算方法一般有算术平均数、几何平均数和中位数，题干所给为不确定数据资料，表示集中趋势时应计算中位数。其中n=8，因此选用公式M=1/2[Xn/2+X（n/2）+1]，即M=11（C对）。